FAD中所含的维生素是
A. 维生素B₁
B. 维生素B₂
C. 维生素B₁₂
D. 泛酸
E. 维生素PP

正确答案：B。维生素B₂

解析：TPP（焦磷酸硫胺素）含维生素B₁（A错），FAD（黄素腺嘌呤二核苷酸）含维生素B₂（B对），辅酶B12含维生素B₁₂（C错），辅酶A（CoA）含泛酸（D错），NAD⁺(烟酰胺腺嘌呤二核苷酸）和NADP⁺(烟酰胺腺嘌呤二核苷酸磷酸）含维生素PP（E错）。